最常发生湿性坏疽的器官是
A. 四肢
B. 肝
C. 脾
D. 肾
E. 肺

正确答案：E。肺

解析：湿性坏疽多发生于与外界相通的内脏，如肺（E对）、肠、子宫、阑尾及胆囊等，也可发生于动脉阻塞及静脉回流受阻的肢体。